残根的拔除或保留应根据
A. 牙根缺损破坏的范围
B. 根尖周组织的健康情况
C. 治疗效果
D. 与修复的关系
E. 以上都对

正确答案：E。以上都对

解析：本题考查修复前残根的处理。确定残根的拔除或保留应根据牙根的缺损破坏范围（A对），根尖周组织的健康情况（B对），并结合治疗效果（C对）与修复的关系（D对）综合考虑。如果残根破坏较大，缺损达龈下无法经牙冠延长术或正畸牵引获得生物学宽度，根尖周组织病变范围较广泛，治疗效果不佳者，可考虑拔除；如果残根较稳固，根尖周组织无明显病变或病变范围较小，同时对义齿的支持和固定有作用者，则应进行根管治疗后保留。综上所述，以上均正确(E对，为本题正确答案)。